女，42岁。乏力、怕冷、便秘伴声音嘶哑1年，体重增加8kg，经检查诊断为甲状腺功能减退症。拟左甲状腺素替代治疗，最适宜的起始剂量为
A. 125ug
B. 100ug
C. 75ug
D. 50ug
E. 25μg

正确答案：E。25μg

解析：甲状腺功能减退常用左甲状腺素作替代治疗，一般从25～50μg/d开始，由于激素替代治疗常从小剂量开始，逐渐增加至生理量，所以最适宜起始剂量为25μg（E对）。